哺乳期妇女最宜采取的避孕方法是
A. 避孕套
B. 宫内节育器
C. 自然避孕
D. 屏障避孕
E. 短效口服避孕药

正确答案：B。宫内节育器

解析：本题考查常用的避孕方法。宫内节育器（B对ACDE错）是哺乳期避孕的最佳选择，产后42天、3个月、剖宫产后6个月都可以放置。哺乳期不宜口服避孕药和安全期避孕。